患者，男，74岁。胸痛持续剧烈，甚则心痛彻背，背痛彻心，形寒肢冷，神疲气怯，伴心悸气促，手足青紫厥冷，舌紫暗苔滑润，脉沉细无力。诊断为急性前壁心肌梗死，其证型是
A. 气阴亏损，心络瘀阻
B. 心肾阳虚，虚阳外越
C. 心脾两虚，痰浊阻遏
D. 气阳虚衰，寒凝心络
E. 心肺气虚，痰瘀互结

正确答案：D。气阳虚衰，寒凝心络

解析：阳气虚衰，胸阳不运，气机痹阻，血行瘀滞，故见心痛彻背，背痛彻心；肾阳虚衰故见形寒肢冷，手足青紫厥冷；心阳不振则神疲气怯，伴心悸气促；舌紫暗苔滑润，脉沉细无力均为心肾阳虚之侯，其病机是素体阳虚，阴寒凝滞，气血痹阻，心阳痹阻，其证型属于气阳虚衰，寒凝心络（D对）。气阴亏损，心络瘀阻（A错）表现为胸闷隐痛，时作时止，心悸气短，倦怠懒言，头晕目眩，心烦多梦，或手足心热。心肾阳虚，虚阳外越（B错）的特点为心悸而痛，胸闷气短，甚则胸痛彻背，心悸汗出，畏寒肢冷，下肢浮肿，腰酸无力，面色苍白。心脾两虚，痰浊阻遏（C错）的特点为胸闷痛如窒，气短痰多，肢体沉重，形体肥胖，纳呆恶心。心肺气虚，痰瘀互结（E错）胸痛较剧，如刺如绞，气短痰多，肢体沉重。